维系DNA双链间碱基配对的化学键是
A. 氢键
B. 磷酸二酯键
C. 肽键
D. 疏水键
E. 糖苷键

正确答案：A。氢键

解析：在DNA双链间，腺嘌呤与胸腺嘧啶通过两个氢键形成碱基对，鸟嘌呤与胞嘧啶通过三个氢键形成碱基对，因此维系DNA双链间碱基配对的化学键是氢键（A对）。糖苷键（P37）（E错）是脱氧核糖和碱基之间的结合键。3＇，5＇-磷酸二酯键（P38）（B错）是核苷酸之间的连接键。肽键（P13）（C错）是氨基酸与氨基酸之间的连接键，维系蛋白质的一级结构；疏水键（P19）（D错）是肽链中某些氨基酸的疏水基团或者疏水侧链之间的相互作用力，维系蛋白质的三级结构。